下列因素与传染病的病原体变异无关的是
A. 抗病毒药物的使用
B. 宿主的遗传因素
C. 机体免疫力
D. 抗生素的大量应用
E. 病原体数量

正确答案：E。病原体数量

解析：病原体可因抗生素的大量应用（D对）、抗病毒药物的使用（A对）或宿主的遗传因素（B对）等因素而发生改变。同时病原体变异可以逃逸机体免疫力（C对）从而继续导致疾病或者使疾病慢性化。与变异性无关的是病原体数量（E错，为本题正确答案），病原体数量为病原体致病能力决定因素之一。